男性患者1例，60岁，1个月来出现咳嗽，咳痰，以白色黏液痰为主，偶带少量血丝，感午后低热，在家自服阿莫西林及止咳糖浆，咳嗽、咳痰稍减轻，低热不退。该患者今到某乡镇卫生院(社区卫生服务中心)就诊，放射科摄胸片检查，胸片疑似有活动性肺结核，问：下一步该卫生院应对患者所做的处理是
A. 先行抗结核治疗排除结核病
B. 将该患者转诊至结核病定点医院或结防门诊
C. 先给予抗生素治疗两周，以排除其他感染
D. 让其回家休息，嘱其两周后再次来院随访
E. 请上级医院派专家来院会诊

正确答案：B。将该患者转诊至结核病定点医院或结防门诊

解析：本题考查对肺结核患者的处理。本题中该患者放射科摄胸片检查，胸片疑似有活动性肺结核，下一步该卫生院应将该患者转诊至结核病定点医院或结防门诊（B对ACDE错）。我国的结核病疫情严重，为了有效控制结核病的传播，在各区、县均设立了结核病防治机构，负责结核病人的诊断、治疗和管理。因症就诊、转诊和因症推荐是实施DOTS策略地区发现肺结核病人的主要方式。